患者，男，30岁。水肿，汗出恶风，身重，小便不利，舌淡苔白，脉浮。治疗应首选
A. 十枣汤
B. 舟车丸
C. 五苓散
D. 防己黄芪汤
E. 猪苓汤

正确答案：D。防己黄芪汤

解析：本题考查常见的病症的辩证、处方。题中患者水肿，汗出恶风，身重，小便不利，舌淡苔白，脉浮，证属表虚不固之风水或风湿证。十枣汤为泻下剂，逐水，具有攻逐水饮之功效。主治悬饮，咳唾胸胁引痛，心下痞硬，干呕短气，头痛目眩，胸背掣痛不得息，舌苔白滑，脉沉弦；水肿，一身悉肿，尤以身半以下肿甚，腹胀喘满，二便不利（A错）。舟车丸，行气利水。用于蓄水腹胀，四肢浮肿，胸腹胀满，停饮喘急，大便秘结，小便 短少（B错）。五苓散为祛湿剂，具有温阳化气，利湿行水之功效。用于阳不化气、水湿内停所致的水肿，症见小便不利、水肿腹胀、呕逆泄泻、渴不思饮（C错）。防己黄芪汤为祛湿剂，具有益气祛风，健脾利水之功效。主治表虚不固之风水或风湿证。汗出恶风，身重微肿，或肢节疼痛，小便不利，舌淡苔白，脉浮（D对）。猪苓汤为祛湿剂，具有利水，养阴，清热之功效。主治水热互结证。小便不利，发热，口渴欲饮，或心烦不寐，或兼有咳嗽、呕恶、下利，舌红苔白或微黄，脉细数。又治血淋，小便涩痛，点滴难出，小腹满痛者（E错）。